下列腧穴中，不属于任脉的是
A. 承浆
B. 膻中
C. 廉泉
D. 水沟
E. 中极

正确答案：D。水沟

解析：水沟属于督脉腧穴第十版针灸学（D错，为本题正确答案）。承浆、膻中、廉泉、中极均属于任脉（ABCE对）。